现行的《传染病防治法》施行的时间是
A. 2004年8月28日
B. 2004年12月1日
C. 2005年8月28日
D. 2005年12月1日
E. 2006年1月1日

正确答案：B。2004年12月1日